透明血栓见于
A. 混合血栓的尾部
B. 白血栓
C. 混合血栓的头部
D. 红血栓
E. DIC

正确答案：E。DIC

解析：透明血栓主要发生于毛细血管内，最常见于DIC（弥散性血管内凝血）（E对）。白色血栓（B错）为延续性血栓的头部（C错），主要见于急性风湿性心内膜炎等。红色血栓（D错）为延续性血栓的尾部（A错），主要见于静脉内。